下列不属于内分泌腺体功能减退常见原因
A. 肿瘤
B. 增生
C. 感染
D. 药物
E. 遗传

正确答案：B。增生

解析：内分泌疾病常根据腺体的功能分类。分为激素产生过多、激素产生过少以及激素在靶组织抵抗。其中内分泌腺体功能减退的常见原因有：内分泌腺体破坏，包括自身免疫损伤，例如1型糖尿病、桥本甲状腺炎；肿瘤压迫，例如垂体瘤压迫产生的继发性肾上腺皮质功能减退症（A对）；感染，例如病毒感染所致的亚急性甲状腺炎（C对）；放射损伤，例如¹³¹I治疗引起的甲减。内分泌激素合成缺陷，例如先天性甲减（E对）。